关于阿司匹林原料药含量测定的说法，正确的有
A. 采用非水溶液滴定法
B. 原理是阿司匹林分子结构中的游离羧基有一定的酸性，可与碱定量反应
C. 使用中性乙醇（对酚酞指示液显中性）为溶剂
D. 采用永停法指示终点
E. 按吸收系数（E1%1cm ）法计算含量

正确答案：B、C。原理是阿司匹林分子结构中的游离羧基有一定的酸性，可与碱定量反应；使用中性乙醇（对酚酞指示液显中性）为溶剂

解析：本题考查药品标准检查项下的内容。关于阿司匹林原料药含量测定的说法，正确的有原理是阿司匹林分子结构中的游离羧基有一定的酸性，可与碱定量反应（B对）、使用中性乙醇（对酚酞指示液显中性）为溶剂（C对）。含量测定方法:以中性乙醇（对酚酞指示液显中性）为溶剂溶解供试品，以酚酞为指示剂，用氢氧化钠滴定液（0.1mol/L）滴定，每1ml氢氧化钠滴定液（0.1mol/L）相当于18.02mg的C₉H₈O₄。阿司匹林分子中具有羧基，原料药可采用直接酸碱滴定法测定含量（A错）。阿司匹林原料药含量测定时，以酚酞为指示剂指示终点（D错）。吸收系数法（E错）是紫外-可见分光光度法的含量测定方法。